关于体温测量，下列不正确的是
A. 应将汞柱甩到35℃以下
B. 婴幼儿不宜用口腔温度计
C. 肛测法测量的温度虽稳定，但使用不方便
D. 使用腋测法时腋窝应干燥
E. 昏迷者应用口测法

正确答案：E。昏迷者应用口测法

解析：体温测量可分为腋测法、口测法和肛测法三种。腋测法使用时应注意腋窝处应无致热或降温物品，并应使腋窝保持干燥（D对）。口测法不能用于婴幼儿（B对）及神志不清者（E错，为本题正确答案）。肛测法测量的温度虽稳定，但使用不方便（C对），多用于婴幼儿及神志不清者。以上三种体温测量方法在测量前都应将汞柱甩到35°C以下（A对）。